我国甲药品批发企业代理了境外乙制药厂商生产的疫苗，销售使用后，发现该疫苗存在安全隐患，应实施召回。根据《药品召回管理办法》，该药品召回行为的主体应是
A. 国家药品监督管理部门
B. 疫苗销售地省级药品监督管理部门
C. 甲药品批发企业所在地省级药品监督管理部门
D. 甲药品批发企业
E. 乙制药厂商

正确答案：E。乙制药厂商

解析：本题考查的是药品召回的责任主体。我国甲药品批发企业代理了境外乙制药厂商生产的疫苗，销售使用后，发现该疫苗存在安全隐患，应实施召回。根据《药品召回管理办法》，该药品召回行为的主体应是乙制药厂商（E对）。药品召回的责任主体：药品上市许可持有人是药品召回的责任主体。药品生产企业应当保存完整的购销记录，建立和完善药品召回制度，收集药品安全的相关信息，对可能具有安全隐患的药品进行调查、评估，召回存在安全隐患的药品。进口药品的境外制药厂商与境内药品生产企业一样也是药品召回的责任主体，履行相同的义务。进口药品需要在境内进行召回的，由进口的企业负责具体实施。